《医疗机构制剂配制质量管理规范（试行）》规定应经专业技术培训，具有基础理论知识和实践操作技能的是
A. 医院药事管理委员会负责人
B. 制剂室和药检室负责人
C. 药品采购人员
D. 医疗机构制剂配制操作及药检人员
E. 药剂科负责人

正确答案：D。医疗机构制剂配制操作及药检人员

解析：本题考查医疗机构配制制剂的质量管理。《医疗机构制剂配制质量管理规范（试行）》第九条规定，从事制剂配制操作及药检人员，应经专业技术培训，具有基础理论知识和实际操作技能（D对）。凡有特殊要求的制剂配制操作和药检人员还应经相应的专业技术培训。